流行病学研究中的生态学研究是探索病因的
A. 一种精细的描述性研究
B. 一种粗线条的描述性研究
C. 特殊的病例对照研究
D. 特殊的队列研究
E. 特殊的流行病学试验

正确答案：B。一种粗线条的描述性研究

解析：本题考查生态学研究的概念。生态学研究又称相关性研究，是描述性研究的一种类型，它是在群体的水平上研究某种暴露因素与疾病之间的关系，以群体为观察和分析的单位，是一种粗线条的描述性研究（B对ACDE错），通过描述不同人群中某因素的暴露状况与疾病的频率，分析该暴露因素与疾病之间的关系。